椎骨间的连结包括椎体间的连结和椎弓间的连结。椎体间的连结是各相邻椎体之间借椎间盘、前纵韧带和后纵韧带等相连结。椎弓间的连结包括黄韧带、棘间韧带和棘上韧带。后纵韧带、黄韧带、棘间韧带和棘上韧带都有限制脊柱过度前屈的作用。可限制脊柱过度后伸的韧带是
A. 棘上韧带
B. 后纵韧带
C. 棘间韧带
D. 黄韧带
E. 前纵韧带

正确答案：E。前纵韧带

解析：前纵韧带（E对）可以限制脊柱过度后伸，后纵韧带（B错）可以限制脊柱过度前屈。